甲状旁腺素对血液中钙磷浓度的调节作用表现为
A. 降低血钙浓度，升高血磷浓度
B. 升高血钙浓度，降低血磷浓度
C. 升高血钙浓度，不影响血磷浓度
D. 降低血钙浓度，不影响血磷浓度
E. 升高血钙血、磷浓度

正确答案：B。升高血钙浓度，降低血磷浓度

解析：本题考察血钙、磷调节中甲状旁腺激素所起的作用。甲状旁腺激素作用于近端肾小管上皮细胞，可减少尿钙排泄、促进磷的排出；作用于骨细胞，主要促进骨钙入血（九版生理学P382），因此甲状旁腺激素对血液中钙磷浓度的调节作用表现为升高血钙浓度，降低血磷浓度（B对）。降低血钙浓度，升高血磷浓度（A错）是慢性肾衰竭时发生钙磷代谢异常的表现。降低血钙浓度，不影响血磷浓度（D错）可见于急性坏死性胰腺炎时，钙离子流入腺泡细胞，造成血钙降低，而血磷无异常。升高血钙血、磷浓度（E错）为活性维生素D₃的作用。